患者，女，26岁，因上腹痛就诊，胃镜显示胃溃疡，¹³C呼气试验结果为阳性，青霉素皮试阴性，医师开具阿莫西林、克拉霉素、奥美拉唑和枸橼酸铋钾4种药物，关于两种抗菌药物服用时间的说法，正确的是
A. 二者均饭后服用，提高胃内药物浓度
B. 二者均饭前服用，避免食物影响吸收
C. 二者均饭前服用，减少胃酸对药物破坏
D. 阿莫西林饭前服用吸收好，克拉霉素饭后服用对胃刺激小
E. 二者均饭后服用，减轻对胃部刺激

正确答案：A。二者均饭后服用，提高胃内药物浓度

解析：本题考查幽门螺杆菌根除四联方案中抗生素用法。根除幽门螺杆菌感染的方案四联疗法中两种抗生素均是餐后立即口服，可以提高药物在胃部的存留时间和浓度（A对），发挥局部的抗菌作用。